多数脊神经节中的神经元属于
A. 假单极神经元
B. 双极神经元
C. 多极神经元
D. 联络神经元
E. 无

正确答案：A。假单极神经元

解析：多数脊神经节中的神经元属于假单极神经元（A对）；双极神经元（B错）见于位于视网膜内的双极细胞、内耳的前庭神经节和蜗神经节内的感觉神经元等；多极神经元 （C错）具有多个树突和一个轴突，中枢部内的神经元绝大部分属于此类；联络神经元 （D错）是在中枢部位于感觉和运动神经元之间的多极神经元。